甲型肝炎高发区年龄分布特征为
A. 以儿童为主
B. 以青年为主
C. 以中年为主
D. 以老年为主
E. 以婴儿为主

正确答案：A。以儿童为主